婴儿首次添加辅食最好的食物是
A. 水果泥
B. 蔬菜泥
C. 米汤
D. 鸡蛋黄
E. 强化铁的米粉

正确答案：E。强化铁的米粉

解析：本题考查过渡期食物的选择。给婴儿首先选择的食物应该易于吸收、满足生长需要，又不易产生过敏的食物。因4～6月龄的婴儿体内贮存铁已消耗，选择的食物还应符合婴儿铁的补充。通常能满足这些条件的食物是强化铁的米粉（E对ABCD错）。